有头疽湿热壅滞型宜选用的方剂是
A. 五味消毒饮
B. 竹叶黄芪汤
C. 黄连解毒汤
D. 仙方活命饮
E. 普济消毒饮

正确答案：D。仙方活命饮

解析：仙方活命饮功效清热解毒，消肿溃坚，活血止痛，主治痈疡肿毒初起，可用于治疗有头疽湿热壅滞证（D对）。五味消毒饮功效清热解毒，消散疔疮，主治火毒结聚之疔疮（A错）。竹叶黄芪汤功效清热养阴，益气生津，为有头疽阴虚火炽证代表方（B错）。黄连解毒汤功效泻火解毒，主治三焦火毒热盛证（C错）。普济消毒饮功效清热解毒，疏风散邪，主治大头瘟（E错）。